某县2016年居民健康状况调查，两周患病率占8.95%，两周就诊率为6.20%，慢性病死亡率为530.84/10万，这些数据中
A. 两周患病率是卫生服务需要指标
B. 慢性病患病率是卫生服务需求指标
C. 两周就诊率是卫生服务需要指标
D. 慢性病患病率是卫生服务利用指标
E. 两周患病率是卫生服务利用指标

正确答案：A。两周患病率是卫生服务需要指标